下列血液生化检查结果中，可作为初步诊断动脉硬化与高脂血症的一个指标是
A. 三酰甘油值降低
B. 血清总胆固醇降低
C. 高密度脂蛋白胆固醇降低
D. 低密度脂蛋白胆固醇降低
E. 极低密度脂蛋白胆固醇降低

正确答案：C。高密度脂蛋白胆固醇降低

解析：本题考查常用血生化检查。下列血液生化检查结果中，可作为初步诊断动脉硬化与高脂血症的一个指标是高密度脂蛋白胆固醇降低（C对）。高密度脂蛋白胆固醇是一种抗动脉粥样硬化的脂蛋白，其水平与动脉硬化和冠心病的发生和发展呈负相关。三酰甘油值降低（A错）见于甲状腺功能亢进症、肾上腺皮质功能减退症、肝功能严重障碍等。血清总胆固醇降低（B错）见于贫血、甲状腺功能亢进症、严重的肝脏疾病、恶性肿瘤等。低密度脂蛋白胆固醇降低（D错）见于营养不良、慢性贫血、肝硬化、甲状腺功能亢进症等。极低密度脂蛋白胆固醇降低（E错）见于营养障碍及慢性贫血等。